花鹿茸茸尖部位的饮片不具备的性状特征是
A. 为圆形薄片
B. 切面浅棕色或浅黄白色，半透明，微有光泽
C. 周边骨质化
D. 外皮红棕色或棕色
E. 质坚韧

正确答案：C。周边骨质化

解析：本题考查的是花鹿茸饮片的性状鉴别。花鹿茸尖部外皮无骨质（C错，为本题正确答案）。花鹿茸：【性状鉴别】饮片花鹿茸尖部切片习称“血片”“蜡片”，为圆形薄片（A对），表面浅棕色或浅黄白色，半透明，微显光泽（B对）；外皮无骨质，周边粗糙，红棕色或棕色（D对）；质坚韧（E对）；气微腥，味微咸。中上部的切片习称“蛋黄片”，切面黄白色或粉白色，中间有极小的蜂窝状细孔。下部习称“老角片”，为圆形或类圆形厚片，表面粉白色或浅白色，中间有蜂窝状细孔，外皮无骨质或略具骨质，周边粗糙，红棕色或棕色。质坚脆。